正确描述足弓的是
A. 由跗骨借韧带相连而成
B. 由跖骨借韧带连结而成
C. 是一前后方向的纵弓
D. 为内外方向的横弓
E. 承重点在第1跖骨头、第5跖骨头和跟骨结节

正确答案：E。承重点在第1跖骨头、第5跖骨头和跟骨结节

解析：足弓是由跗骨和跖骨连接而成（AB错），可分为前后方向的内、外侧纵弓（C错）和内外方向的一个横弓（D错）。内侧纵弓的最高点为距骨头，前端的承重点主要在第1 跖骨头。外侧纵弓的最高点为骰骨，前端的承重点在第5 跖骨头，后端的承重点是跟骨结节（E对）。